卫生法的实施不体现的
A. 卫生执法
B. 卫生司法
C. 卫生服务
D. 卫生守法
E. 行使权力是遵守卫生法的授权性规范

正确答案：C。卫生服务

解析：卫生法的守法、执法和司法。卫生法的守法内容包括履行义务和行使权力。掌握“卫生法的守法、执法和司法”知识点。